关于佐剂的叙述，下列哪项是错误的
A. 佐剂是特异性免疫增强剂
B. 与免疫原混合后可增强抗原在体内存留时间
C. 最常用于动物实验的是弗氏佐剂
D. 延长抗原在机体内保留时间
E. 刺激淋巴细胞分化，增加扩大免疫应答能力

正确答案：A。佐剂是特异性免疫增强剂

解析：佐剂是非特异性免疫增强剂，当与抗原一起注射或预先注入机体时，可增强机体对抗原的免疫应答或改变免疫应答类型。佐剂有很多种；例如氢氧化铝佐剂、短小棒状杆菌、脂多糖、细胞因子、明矾等。弗氏完全佐剂和弗氏不完全佐剂是目前动物试验中最常用佐剂。佐剂增强免疫应答的机制是通过改变抗原的物理形状，延长抗原在机体内保留时间；刺激单核吞噬细胞对抗原的提成能力；刺激淋巴细胞分化，增加扩大免疫应答能力。掌握“抗原基本概念、分类、超抗原及佐剂”知识点。